牙槽骨水平吸收时形成的牙周袋通常为
A. 骨上袋
B. 骨内袋
C. 复杂袋
D. 一壁骨袋
E. 四壁骨袋

正确答案：A。骨上袋

解析：水平型吸收是最常见的吸收方式。牙槽间隔，唇颊侧或舌侧的嵴顶边缘呈水平吸收，而使牙槽嵴高度降低，通常形成骨上袋。掌握“慢性牙周炎的病因，表现诊断及预后”知识点。